以下所述牙体缺损的原因哪项是错误的
A. 酸蚀症
B. 斑釉牙
C. 四环素牙
D. 夜磨牙
E. 戴（牙合）垫

正确答案：E。戴（牙合）垫

解析：本题考查牙体缺损的病因。戴（牙合）垫（E错，为本题的正确答案）是对夜磨牙者牙齿的保护，不会造成牙体缺损。酸蚀症者牙体组织会逐渐丧失，表现为牙体缺损（A对），主要是前牙。斑釉牙（B对）、四环素牙（C对）属于牙体组织发育畸形，严重者会出现牙体缺损。夜磨牙（D对）属于病理性磨损，表现为咬合面降低，严重者可导致垂直距离变短引起咀嚼功能障碍以及颞下颌关节紊乱病。